男，20岁。3年前无明显诱因渐起孤僻少语，不愿参加集体活动，甚至与父母也很少交流，上课时注意力不集中，成绩下降。个人生活懒于料理。该患者的主要症状为
A. 行为障碍
B. 认知功能障碍
C. 阳性症状
D. 阴性症状
E. 思维联想障碍

正确答案：D。阴性症状

解析：该青年患者，3年前（起病缓慢）无明显诱因渐起孤僻少语，不愿参加集体活动，甚至与父母也很少交流，上课时注意力不集中，成绩下降（缺乏进取心），个人生活懒于料理（生活懒散），主要以阴性症状为表现，故最可能的诊断为精神分裂症单纯型。精神分裂单纯型以阴性症状为主症（D对）。